月经周期规则，末次月经第一日是2005年4月18日，推算预产期应是
A. 2006年1月22日
B. 2006年1月23日
C. 2006年1月24日
D. 2006年1月25日
E. 2006年1月27日

正确答案：D。2006年1月25日

解析：末次月经第一日是2005年4月18日，按照推算预产期的方法：按末次月经第1日算起，月份减3或加9，日数加7，可推算出预产期是2006年1月25日（D对）。